患者胃痛，脘腹胀满，嗳腐吞酸，吐不消化食物，大便不爽，舌苔厚腻，脉滑。其治法是
A. 理气消胀
B. 消食导滞
C. 理气和胃
D. 消食健脾
E. 和胃止呕

正确答案：B。消食导滞

解析：题中患者虽有呕吐不消化食物的现象，但呕吐无胃痛的症状，且患者以胃痛为主症，故诊断为胃痛。胃痛，脘腹胀满为饮食不节，伐伤胃气，致胃气壅滞，失于通降所致；食积中阻，上逆嗳腐，故嗳腐吞酸，吐不消化食物；舌苔厚腻，脉滑为饮食积滞之象，故辨为饮食伤胃证。理气消胀用于气滞证（A错）。胃痛饮食伤胃证首当消食导滞（B对）。理气和胃为胃痛总的治疗法则（C错）。消食健脾用于脾虚食滞（D错）。和胃止呕用于呕吐（E错）。